口腔医生了解和评估口腔患者的健康状态主要是通过
A. 疾病的流行趋势
B. 疾病造成损伤的大小
C. 疾病的传播途径
D. 疾病对动物的危险性
E. 患者检查与评价采集病史

正确答案：E。患者检查与评价采集病史

解析：口腔医生主要通过患者检查与评价采集病史来了解和评估口腔患者的健康状态。掌握“患者、医务人员及环境的防护”知识点。